患者，女，28岁。经来淋沥不净，经色鲜红，诊为崩漏，近日颜面长有痤疮，色红肿痛，舌红苔略黄，脉细数。治疗应首选
A. 白茅根、芦根
B. 大蓟、小蓟
C. 地榆、白及
D. 艾叶、地榆
E. 三七、茜草

正确答案：B。大蓟、小蓟

解析：患者经来淋沥不净，经色鲜红，舌红苔略黄，脉细数，为血热妄行，所致崩漏；同时还有痤疮，色红肿痛，应凉血兼散瘀解毒；首选凉血止血，散瘀解毒消痈的大蓟、小蓟（B对A错）白茅根：凉血止血，清热利尿。芦根：清热泻火，生津止渴，除烦止呕，利尿（C错）。地榆：凉血止血，解毒疗疮。白及：收敛止血，消肿生肌（D错）。艾叶：温经止血，散寒调经，外用祛湿止痒（E错）。三七：散瘀止血，消肿定痛。茜草：凉血祛瘀，止血通经。